基牙倒凹的深度和倒凹的坡度一般为
A. 倒凹的深度应大于1mm，倒凹的坡度应小于10°
B. 倒凹的深度应大于1mm，倒凹的坡度应小于20°
C. 倒凹的深度应小于1mm，倒凹的坡度应小于10°
D. 倒凹的深度应小于1mm，倒凹的坡度应小于20°
E. 倒凹的深度应小于1mm，倒凹的坡度应大于20°

正确答案：E。倒凹的深度应小于1mm，倒凹的坡度应大于20°

解析：基牙一般倒凹的深度应小于1mm，铸造卡环臂要求的倒凹深度偏小，不宜超过0.5mm，倒凹的坡度应大于20°。掌握“局部义齿的设计”知识点。